脊髓灰质炎典型热型是
A. 双峰热
B. 弛张热
C. 间歇热
D. 稽留热
E. 低热

正确答案：A。双峰热

解析：脊髓灰质炎典型热型是双峰热（A对）。双峰热是指发热患儿3～5天体温降至正常后，体温又再次升高的情况。